可用于治疗成人类风湿性关节炎，也可用于治疗狼疮性肾炎的药物是
A. 双醋瑞因
B. 金诺芬
C. 布洛芬
D. 来氟米特
E. 柳氮磺吡啶

正确答案：D。来氟米特

解析：本题考查来氟米特。可用于治疗成人类风湿性关节炎，也可用于治疗狼疮性肾炎的药物是来氟米特（D对）；双醋瑞因（A错）用于治疗退行性关节疾病；金诺芬（B错）用于治疗典型或肯定的活动性类风湿性关节炎；布洛芬（C错）用于缓解轻至中度疼痛，也用于普通感冒或流行性感冒引起的发热；柳氮磺吡啶（E错）用于治疗溃疡性结肠炎、类风湿性关节炎等。